不属于急性胰腺炎手术适应症的是
A. 多次反复发作胰腺炎
B. 继发性胰腺感染、脓肿
C. 胰腺假性囊肿
D. 急性水肿性胰腺炎
E. 胆源性胰腺炎

正确答案：D。急性水肿性胰腺炎

解析：急性水肿性胰腺炎（D错，为本题正确答案）病情较轻，多数病人经保守治疗可痊愈，不需要手术治疗。急性胰腺炎的手术适应证包括：①急性腹膜炎不能排除其他急腹症时；②胰腺和胰周坏死组织继发感染、脓肿（B对）；③伴胆总管下端梗阻或胆道感染的胆源性胰腺炎（E对）；④合并肠穿孔、大出血或胰腺假性囊肿（C对）。多次反复发作的胰腺炎（A对）也属于手术指征。